小儿腹泻，重度脱水，第一天静脉补液量为
A. 60～90ml/kg
B. 150～180ml/kg
C. 180～210ml/kg
D. 90～120ml/kg
E. 120～150ml/kg

正确答案：B。150～180ml/kg

解析：小儿第1天静脉补液总量=累计损失量+继续损失量+生理需要量，轻度脱水为90-120ml/kg（D错），中度脱水为120-150ml/kg（E错），重度脱水为150-180ml/kg（B对）。